以下哪项不属于评价试验真实性的指标
A. 灵敏度
B. 假阴性率
C. 客观性
D. 假阳性率
E. 特异度

正确答案：C。客观性

解析：评价试验真实性的指标有灵敏度、特异度、假阳性率、假阴性率、约登指数和粗一致性。掌握“流行病的诊断和筛检试验及疾病监测”知识点。